夜间阵发性呼吸困难发生的主要机制是
A. 平卧时回心血量减少
B. 平卧时水肿液不易入血
C. 迷走神经紧张性降低
D. 入睡后神经反射的敏感性降低
E. 夜间周围血管紧张性增高

正确答案：D。入睡后神经反射的敏感性降低

解析：左心衰时夜间阵发性呼吸困难的机制是：①夜间平卧时，下半身静脉回流增多，毛细血管有效滤过压降低，使水肿液吸收入血增多（B错），回心血量增加（A错）。②入睡后迷走神经紧张性增高（C错），周围血管紧张性降低（E错），小支气管收缩，气道阻力增大。③入睡后神经反射的敏感性降低（D对），只有当肺淤血严重到一定程度使动脉血氧分压降低明显，才能刺激呼吸中枢，使患者感到呼吸困难而惊醒。